处方中书写炒三仙，应付
A. 炒谷芽、炒白术、炒神曲
B. 炒山楂、炒麦芽、炒谷芽
C. 炒麦芽、炒白术、炒山楂
D. 炒苍术、炒谷芽、炒栀子
E. 炒神曲、炒山楂、炒麦芽

正确答案：E。炒神曲、炒山楂、炒麦芽

解析：本题考查的是处方调配。处方中书写炒三仙，应付炒神曲、炒山楂、炒麦芽（E对）。处方药名：炒三仙。调配应付：炒神曲、炒山楂、炒麦芽。